牙本质龋的最深层是
A. 透明层
B. 脱矿层
C. 细菌侵入层
D. 坏死崩解层
E. 暗层

正确答案：A。透明层

解析：透明层：透明层又称硬化层，为牙本质龋最深层、最早出现的改变，位于病变的底部和侧面，在透射光下呈均质透明状。掌握“牙本质，牙骨质龋”知识点。